城市垃圾综合整治的目标是
A. 综合化、减量化、资源化
B. 无害化、综合化、系统化
C. 无害化、减量化、资源化
D. 无害化、系统化、资源化
E. 综合化、减量化、系统化

正确答案：C。无害化、减量化、资源化

解析：本题考查城市垃圾综合整治的目标。城市垃圾是城市居民的生活垃圾、商业垃圾、市政维护和管理中产生的垃圾，其处理目标是无害化、减量化和资源化（C对ABDE错）。